男，12岁，因频发时轻时重的口吃就诊，经暗谈，心理治疗师认为患儿的口吃症状与其父母感情不好，总在他面前争吵并动辄以离婚相威胁有关，遂要求三人一起接受心理治疗，并采用了循环提问等技术，该心理治疗法称为
A. 家庭治疗
B. 精神分析疗法
C. 人本主义疗法
D. 行为疗法
E. 认知疗法

正确答案：A。家庭治疗

解析：在治疗中，心理治疗师要求三人一起接受心理治疗（以家庭为单位），并采用了循环提问等技术（是家庭治疗的治疗方式之一）（A对）。精神分析疗法（B错）是团体治疗方法，为了某种共同目的将多个当事人集中起来共同治疗（P235）。人本主义疗法（C错）用于治疗由于他人价值观的施加而导致个体自我经验与自我经历不一致，迫使其歪曲自我感受和情感、情绪的心理障碍。行为疗法（D错）是建立在行为学习理论基础上的心理治疗方法，是根据条件反射学说和社会学习理论，以减轻和改善来访者的症状和不良反应为目标的一类心理治疗技术总称（P208）。认知疗法（E错）用于纠正因歪曲或错误的思维导致的心理障碍，而该患者的心理障碍并非由歪曲错误思维引起。